急性心肌梗死最常见并发症是
A. 体循环栓塞
B. 心肌梗死后综合征
C. 肺动脉栓塞
D. 心室膨胀瘤
E. 心脏乳头肌功能失调或断裂

正确答案：E。心脏乳头肌功能失调或断裂

解析：急性心肌梗死的并发症有五种，其中最常见的为乳头肌功能失调或断裂（E对），总发生率可高达50%。体循环栓塞（A错）多由左心室附璧血栓脱落所致，而肺动脉栓塞（C错）是因下肢静脉血栓脱落所致，两者的总发生率为1%～6%。心梗后综合症（B错）多于心肌梗死数周至数月内出现，发生率约10%。心室膨胀瘤（D错）主要见于左心室，发生率为5%～10%。